下列哪项不是学校开展生活技能教育的原则
A. 尽早开展，注重实践
B. 坚持以学生为主体
C. 注重培训教师
D. 和家庭、社区密切配合
E. 以提高学生考试成绩为目标

正确答案：E。以提高学生考试成绩为目标